某女，3岁。患百日咳，症见咳嗽阵作，痰鸣气短，咽干声哑，证属痰浊阻肺，治当宣肺、化痰、止咳，宜选用的成药是
A. 鹭鸶咳丸
B. 儿童清肺合剂
C. 清宣止咳颗粒
D. 小儿咳喘灵颗粒
E. 小儿消积止咳口服液

正确答案：A。鹭鸶咳丸

解析：本题考查的是鹭鸶咯丸功能。某女，3岁。患百日咳，症见咳嗽阵作，痰鸣气短，咽干声哑，证属痰浊阻肺，治当宣肺、化痰、止咳，宜选用的成药是鹭鸶咯丸（A对）。鹭鸶咯丸：【功能】宣肺，化痰，止咳。儿童清肺丸（B错）：【功能】清肺，解表，化痰，止嗽。清宣止咳颗粒（C错）：【功能】疏风清热，宣肺止咳。小儿咳喘灵颗粒（D错）：【功能】宣肺清热，止咳祛痰，平喘。小儿消积止咳口服液（E错）：【功能】清热肃肺，消积止咳。